男，70岁。近4个月来反复脓血样便，3~4次/日，经治疗稍缓解。5天前停止排便，伴呕吐，不能进食。查体：全腹膨隆，对称，未触及肿块，肠鸣音10次/分，直肠指诊未及异常。结肠镜检：距肛门10cm可见环形狭窄，成菜花样外观，肠镜不能通过。最可能的诊断是
A. 直肠癌
B. 乙状结肠扭转
C. 克罗恩病
D. 直肠息肉
E. 溃疡性结肠炎

正确答案：A。直肠癌

解析：老年患者，反复脓血样便，腹泻（排便习惯和排便性状的改变）。5天前停止排便，伴呕吐，不能进食，腹胀，肠鸣音亢进（肠梗阻表现）。结肠镜检：距肛门10cm可见环形狭窄，成菜花样外观，肠镜不能通过。最可能的诊断是直肠癌（A对）。乙状结肠扭转（B错）多见于乙状结肠冗长、有便秘的老年人，以往可有多次腹痛发作经排气、排便后缓解的病史。病人有腹部持续胀痛，左腹部明显膨胀，可见肠型。腹部X线平片显示马蹄状巨大的双腔充气肠袢，圆顶向上；立位可见两个液平面。钡剂灌肠X线检查见扭转部位钡剂受阻，钡影尖端呈“鸟嘴”形（P364）。克罗恩病（C错）起病常较缓慢，病史较长。腹泻腹痛体重下降是其常见症状，可见黏液血便。腹痛常位于右下腹或脐周。部分病人出现肠梗阻症状，但多为不完全性。部分病人以肛周病变为首诊症状。结肠镜见纵行溃疡、黏膜呈卵石样，病变间的黏膜正常（P358）。直肠息肉（D错）直肠指诊可扪及质软可推动的圆形肿块，多发息肉则可扪及大小不等的质软肿块，移动度大的息肉多可扪及蒂部（P384）。溃疡性结肠炎（E错）主要症状为反复发作的腹泻、黏液脓血便及腹痛。结肠镜见溃疡浅，黏膜弥漫性充血水肿、颗粒状，结肠袋变浅、变钝或消失。（P375）。